降低工作场所流体动力性噪声源的噪声强度主要的技术措施是
A. 隔声
B. 吸声
C. 消声
D. 技术改造
E. 声源移出室外

正确答案：C。消声

解析：本题考查降低流体动力性噪声的主要技术措施。降低工作场所流体动力性噪声源的噪声强度主要的技术措施是消声（C对ABDE错）。消声用于风道和排气管，常用的有阻性消声器和抗性消声器。